念珠菌阴道炎的确诊依据是
A. 有阴道炎病史
B. 白色稠厚豆渣样白带
C. 分泌物中找到白念珠菌孢子和假菌丝
D. 分泌物中找到了细菌
E. 检查发现小阴唇内侧及阴道黏膜附有白色膜状物

正确答案：C。分泌物中找到白念珠菌孢子和假菌丝